下列化合物不属于糖异生的原料的是
A. 甘油
B. 氨基酸
C. 丙酮酸
D. 乳酸
E. 脂肪酸

正确答案：E。脂肪酸